女，43岁。诊断风湿性心脏瓣膜病20余年。查体：心前区未触及震颤，胸骨左缘第3肋间可闻及舒张期叹气样杂音，心尖部可闻及舒张早中期杂音，S₁减弱。最可能的诊断是
A. 主动脉瓣关闭不全伴二尖瓣器质性狭窄
B. 主动脉瓣关闭不全伴二尖瓣相对性狭窄
C. 主动脉瓣器质性狭窄伴二尖瓣器质性狭窄
D. 主动脉瓣相对性狭窄伴二尖瓣相对性狭窄
E. 主动脉瓣相对性狭窄伴二尖瓣器质性狭窄

正确答案：B。主动脉瓣关闭不全伴二尖瓣相对性狭窄

解析：患者中年女性，有风湿性心脏瓣膜病史，胸骨左缘第3肋间（主动脉瓣第二听诊区）可闻及舒张期叹气样杂音（主动脉瓣关闭不全的特征性杂音），因此首先考虑为主动脉瓣关闭不全（CDE错）。当主动脉瓣关闭不全引起严重主动脉瓣反流时，左心室血容量增多及舒张期压力增高，将二尖瓣前侧叶推起处于较高位置引起相对二尖瓣狭窄，此时可于心尖部闻及隆隆样舒张期杂音（Austin-Flint杂音），与本例患者杂音性质完全相符，因此患者最可能的诊断是主动脉瓣关闭不全伴二尖瓣相对性狭窄（B对A错）。